可用K-K反应鉴别的是
A. α-去氧糖
B. 葡萄糖
C. L-鼠李糖
D. 芸香糖
E. 麦芽糖

正确答案：A。α-去氧糖

解析：本题考查的是强心苷的颜色反应。可用K-K反应鉴别的是α-去氧糖（A对）。Keller-Kiliani（K-K）反应：取样品1mg，用冰醋酸5ml溶解，加20%的三氯化铁水溶液1滴，混匀后倾斜试管，沿管壁缓慢加入浓硫酸5ml，观察界面和乙酸层的颜色变化。如有α-去氧糖，则乙酸层显蓝色。此反应是α-去氧糖的特征反应，只对游离的α-去氧糖或α-去氧糖与苷元连接的苷显色。但对此反应不显色的有时未必具有完全的否定意义。α-去氧糖常见于强心苷类，是区别于其他苷类成分的一个重要特征。强心苷中普遍具有α-去氧糖，如D-洋地黄毒糖等2，6-二去氧糖；L-夹竹桃糖、D-加拿大麻糖、D-迪吉糖和D-沙门糖等2，6-二去氧糖甲醚。葡萄糖（B错）属于六碳醛糖，L-鼠李糖（C错）属于甲基五碳醛糖，芸香糖（D错）、麦芽糖（E错）为与苷元连接的二糖，均非α-去氧糖。